根据《抗菌药物临床应用管理办法》，医疗机构开展细菌耐药监测工作，建立细菌耐药预警机制。对主要目标细菌耐药率超过30%未达到40%的抗菌药物，应采取的措施是
A. 慎重经验用药
B. 参照药敏试验结果选用
C. 暂停临床应用，追踪细菌耐药监测结果
D. 将预警信息通报本医疗机构医务人员

正确答案：D。将预警信息通报本医疗机构医务人员

解析：本题考查的是细菌耐药预警。根据《抗菌药物临床应用管理办法》，医疗机构开展细菌耐药监测工作，建立细菌耐药预警机制。对主要目标细菌耐药率超过30%未达到40%的抗菌药物，应采取的措施是将预警信息通报本医疗机构医务人员（D对）。细菌耐药预警：医疗机构应当开展细菌耐药监测工作，建立细菌耐药预警机制，并采取下列相应措施：①主要目标细菌耐药率超过30%的抗菌药物，应当及时将预警信息通报本医疗机构医务人员；②主要目标细菌耐药率超过40%的抗菌药物，应当慎重经验用药（A错）；③主要目标细菌耐药率超过50%的抗菌药物，应当参照药敏试验结果选用（B错）；④主要目标细菌耐药率超过75%的抗菌药物，应当暂停针对此目标细菌的临床应用，根据追踪细菌耐药监测结果（C错），再决定是否恢复临床应用。